外用膏剂中药物的透皮吸收过程为
A. 浸润、渗透、吸收
B. 释放、穿透、吸收
C. 解吸、溶解、吸收
D. 释放、溶出、吸收
E. 渗透、穿透、吸收

正确答案：B。释放、穿透、吸收

解析：本题考查药物透皮吸收的途径。外用膏剂中药物的透皮吸收过程为释放、穿透、吸收（B对）。外用膏剂药物透皮吸收途径：外用膏剂中药物透皮吸收包括释放、穿透及吸收三个阶段。炮制目的为增强药物疗效：炮制可以通过多方面的影响增强药物疗效。药物药效成分能否较好地从饮片组织细胞内溶解释放出来，将直接关系到药效成分的吸收，从而影响疗效。许多中药经炮制以后，其药效成分溶出（D错）率往往高于原药材，这与药材在切制过程所产生的变化有关，如细胞破损、比表面积增大等。此外，经过炮制中的蒸、煮、炒、煅等热处理后，药材质地或组织结构发生改变，亦可增加某些药效成分的溶出率。药材在炮制条件下的热处理后，其细胞组织及所含成分发生一系列物理、化学变化，可使某些难溶于水的成分水溶性增加。古人认为，“决明子、莱菔子、芥子、苏子、韭子、青葙子，凡药用子者俱要炒过，入药方得味出”。这是因为多数种子类药材外有坚硬的种皮，疏水性强，在煎煮过程中影响溶剂的浸润和渗透（A错），造成药效成分不易被煎出，经加热炮制后种皮爆裂，质地变疏松，增加了与溶剂的接触面积，有利于成分的解吸与溶解（C错），从而便于成分煎出。